患者，女，37岁，已婚。反复阴痒半年余，经治未愈，近5天来阴中奇痒，带下量多如乳凝状；妇科检查：外阴阴道粘膜附有白色膜状物，擦去后见粘膜充血水肿，阴道分泌物镜检见白色念珠菌。治疗应首选
A. 制霉菌素栓纳药加塌痒方外洗
B. 制霉菌素栓纳药加2%～3%苏打液冲洗
C. 达克宁栓纳药加塌痒方外洗
D. 制霉菌素口服加2%～3%苏打液冲洗
E. 制霉菌素口服加制霉菌素栓纳药

正确答案：B。制霉菌素栓纳药加2%～3%苏打液冲洗

解析：患者为中年女性，已婚，反复阴痒半年，加重5天，带下量多如乳凝状。妇科检查：外阴阴道粘膜附有白色膜状物，擦去后见粘膜充血水肿阴道分泌物镜检见白色念珠菌。可判断患者为外阴阴道假丝酵母菌病，故治疗应采用制霉菌素栓药加2%～3%苏打液冲洗调节阴道酸碱度（B对）。